患者，女，30岁，已婚。1年前因产后大失血，月经逐渐后延，量少、色淡、质稀，现停经6个月余，头晕目眩，心悸气短，毛发脱落，皮肤干燥，舌淡红苔薄白，脉虚细。治疗应首选
A. 人参养荣汤
B. 归脾汤
C. 加减一阴煎
D. 举元煎
E. 归肾丸

正确答案：A。人参养荣汤

解析：该患者，女，30岁，因大失血致月经延后，渐至经闭不行，故诊断为闭经。产后大失血，营血亏虚，血虚气弱，冲任不充，不能按时满溢，故月经逐渐延后，未及时治疗，脏腑气血进一步亏损，血海空虚，无血可下而月经停闭。血虚不能营养脏腑官窍皮肤毛发，故头晕目眩，心悸气短，毛发脱落，皮肤干燥。舌淡红，苔薄白，脉虚细均为气血虚弱之征，故辨为气血虚弱证，治宜益气养血调经，方选人参养荣汤（A对）。归脾汤功能益气补血，健脾养心，主治心脾气虚两虚证及脾不统血证（B错）。加减一阴煎功能养阴清热调经，为闭经阴虚血燥的选方（C错）。举元煎功能益气升提，可治疗月经过多及经期延长的气虚证（D错）。归肾丸功能滋阴养血，填精益髓，主治肾阴不足，精衰血少证（E错）。